属于直接凝集反应的是
A. 肥达反应
B. 单向琼脂扩散
C. 双向琼脂扩散
D. 对流免疫电泳
E. 抗“O”试验

正确答案：A。肥达反应